发生涎瘘最常见的部位
A. 腮腺
B. 唇腺
C. 舌下腺
D. 下颌下腺
E. 腭部小涎腺

正确答案：A。腮腺

解析：涎瘘是指唾液不经导管系统排入口腔而流向面颊皮肤表面。腮腺是最常见的部位，损伤是主要的原因。掌握“舌下腺及唾液腺黏液囊肿”知识点。